大肠的下合穴是
A. 委中
B. 足三里
C. 上巨虚
D. 下巨虚
E. 阳陵泉

正确答案：C。上巨虚

解析：该题考查下合穴。下合穴主要用于治疗六腑疾病。上巨虚为大肠的下合穴（C对），委中为膀胱经的下合穴（A错），足三里为胃经的下合穴（B错），下巨虚为小肠经的下合穴（D错），阳陵泉为胆经的下合穴（E错）。记忆：胃三里、上下巨虚大小肠、（委阳穴）阳三焦（委中穴）中膀胱、胆阳陵泉。